非天然来源的胆碱脂酶抑制剂是
A. 长春西汀
B. 盐酸多奈哌齐
C. 石杉碱甲
D. 茴拉西坦
E. 吡拉西坦

正确答案：B。盐酸多奈哌齐

解析：本题考查胆碱脂酶抑制剂。盐酸多奈哌齐（B对）是一种非天然来源的强效可逆性乙酰胆碱脂酶抑制剂类；长春西汀（A错）为磷酸二脂酶抑制剂；石杉碱甲（C错）为一种可逆性胆碱脂酶抑制剂，为我国首创从天然植物（千层塔）中提取，属于天然来源的胆碱脂酶抑制剂；茴拉西坦（D错）和吡拉西坦（E错）属于酰胺类中枢兴奋药。